翼腭窝又称为
A. 颞间隙
B. 翼腭间隙
C. 翼下颌间隙
D. 颞下间隙
E. 腮腺间隙

正确答案：B。翼腭间隙

解析：翼腭间隙（翼腭窝）位于眶尖的下方、颞下窝的内侧。掌握“面侧深区及颌面部各间隙的境界”知识点。